含香豆素类成分的药材是
A. 吴茱萸
B. 巴豆
C. 栀子
D. 薏苡仁
E. 补骨脂

正确答案：E。补骨脂

解析：本题考查的是补骨脂的成分。含香豆素类成分的药材是补骨脂（E对）。补骨脂含有多种香豆素类成分，包括补骨脂内酯（补骨脂素）、异补骨脂内酯（异补骨脂素）和补骨脂次素等。吴茱萸（A错）含吴茱萸碱，属于色胺吲哚类生物碱。巴豆（B错）含巴豆苷，属于氮苷。栀子（C错）中的主要有效成分为栀子苷、京尼平苷和京尼平苷酸等，属于C-4位有取代基的环烯醚萜苷。薏苡仁（D错）的成分，2022年考试指南未明确说明。